用漂白粉消毒时，水的pH升高会影响消毒效果，其原因是在消毒过程中同时产生
A. OCl⁻
B. HOCl
C. Ca（OH）₂
D. Ca（OCl）
E. CaCl₂

正确答案：C。Ca（OH）₂

解析：本题考查漂白粉消毒。漂白粉的化学式为Ca（OCl）Cl，其消毒过程为2Ca（OCl）Cl＋2H₂0→Ca（OH）₂＋2HOCl＋CaC1₂。用漂白粉消毒时，水的pH升高会影响消毒效果，其原因是在消毒过程中同时产生Ca（OH）₂（C对ABDE错）。